颞下间隙的特点中，不恰当的说法是
A. 颞下间隙处于颌面深部诸间隙的中央
B. 间隙中有翼丛
C. 可伸入邻近间隙，借翼丛与海绵窦相通
D. 间隙中有翼丛上颌动脉
E. 颞下间隙的感染常常单独存在，不与相邻间隙感染同时存在

正确答案：E。颞下间隙的感染常常单独存在，不与相邻间隙感染同时存在

解析：颞下间隙在解剖上有两个特点：①颞下间隙处于颌面深部诸间隙的中央；②间隙中有翼丛、上颌动脉及其分支和上、下颌神经的分支通过。间隙中的蜂窝组织伴随上述血管神经伸入邻近诸间隙，使颞下间隙与颞间隙、翼颌间隙、颊间隙、翼腭间隙及咽旁间隙相通，并借眶下裂与眶内、经卵圆孔和棘孔与颅腔通连，借翼丛与海绵窦相通。因此颞下间隙的感染很少单独存在，常与相邻间隙感染同时存在。掌握“面侧深区及颌面部各间隙的境界”知识点。